24岁妇女，因妊娠8周行负压吸宫人工流产术。术中出现血压下降、心率过慢、面色苍白、出汗、胸闷，正确处置应是
A. 立即输液输血
B. 肌注肾上腺素
C. 静脉注射阿托品
D. 静脉滴注间羟胺
E. 终止手术，待病情好转再进行

正确答案：C。静脉注射阿托品

解析：患者行负压吸宫人工流产术，术中出现血压下降、心率过慢、面色苍白、出汗、胸闷，考虑出现人工流产综合反应，发现症状应立即停止手术，给予吸氧，一般多能自行恢复。患者出现迷走神经兴奋症状，已发生休克，应加用阿托品0.5～1mg静脉注射（C对）。